抑制过氧化酶系统，使酪氨酸碘化缩合过程受阻的药物是
A. 左甲状腺素
B. 胺碘酮
C. 放射性¹³¹I
D. 碘海醇
E. 丙硫氧嘧啶

正确答案：E。丙硫氧嘧啶

解析：本题考查丙硫氧嘧啶药理作用。丙硫氧嘧啶（E对）能抑制过氧化酶系统，使摄入到甲状腺细胞内的碘化物不能氧化成活性碘，酪氨酸不能碘化。